属于脾不统血者，宜选用的方剂是
A. 固冲汤
B. 圣愈汤
C. 固阴煎
D. 调肝汤
E. 四物汤

正确答案：A。固冲汤

解析：本题考查崩漏之脾不统血证的方剂应用。属于脾不统血者，宜选用的方剂是固冲汤（A对）。崩漏之脾不统血证【症状】出血量多，日久而止，气短神疲，面色㿠白，或面浮肢肿，手足不温，或饮食不佳，大便溏。舌质淡，苔薄白，脉弱或沉弱。【方剂应用】基础方剂固冲汤。痛经之气血虚弱证【症状】经期或经后小腹隐痛喜按，或小腹空坠不适，月经量少，色淡，质清稀；面色无华，头晕心悸，神疲乏力。舌淡，脉细无力。【方剂应用】基础方剂圣愈汤（B错）。月经先期之肾气虚证【症状】月经周期提前，经量或多或少，色淡暗，质清稀；腰膝酸软，头晕耳鸣，面色晦暗或面有暗斑。舌淡暗，苔白，脉沉细。【方剂应用】基础方剂固阴煎（C错）。痛经之肝肾亏虚证【症状】经期或经后小腹绵绵作痛，经行量少，色暗淡，质稀薄；腰膝酸软，头晕耳鸣；舌淡红，苔薄，脉沉细。【方剂应用】基础方剂调肝汤（D错）。虚劳之血虚证【症状】头晕眼花，心悸多梦，手足发麻，面色淡黄或淡白无华，口唇、爪甲色淡，妇女月经量少。舌质淡，脉细。【方剂应用】基础方剂四物汤（E错）加减。